内源性或外源性激素导致第二性征提前出现者为
A. 同性性早熟
B. 异性性早熟
C. 真性性早熟
D. 假性性早熟
E. 特发性性早熟

正确答案：D。假性性早熟

解析：假性性早熟会由于内源性或外源性激素导致第二性征提前出现，如误服含性激素的药物、食物或接触含雌激素的化妆品等因素，但一般无性腺增大，下丘脑2016U4-垂体2016U4-性腺轴并未发动。性早熟表现根据不同病因表现有一定差异（D对）。在临床上，性征与真实性别一致的称为同性性早熟（A错），不一致者称为异性性早熟（B错）。真性性早熟，是由于儿童 HPGA轴功能提前启动所致。下丘脑GnRH脉冲释放明显增强，垂体LH、FSH 和卵巢、睾丸类固醇性激素浓度提前升高，配子开始形成，其发病机制复杂。其中原因不明者，称为特发性性早熟（CE错）。中枢性性早熟临床表现中第二性征发育的顺序与正常发育是一致的，但是明显提前并且加速，由于过早发育引起患儿近期蹄长，骨骼生长加速，骨龄提前，骨骺可提前融合，影响终生身高。